健康教育计划设计包括健康问题分析、行为问题分析、资源分析、确定优先项目、确定目标、制定干预策略和实施计划及制订
A. 分析计划
B. 教育计划
C. 评价计划
D. 服务计划
E. 执行计划

正确答案：C。评价计划